可用于口腔疾病发展趋势的监测，以观察各种因素对口腔疾病流行的影响的是
A. 口腔预防医学
B. 口腔保健医学
C. 口腔解剖学
D. 口腔流行病学
E. 口腔修复学

正确答案：D。口腔流行病学

解析：口腔流行病学还可用于口腔疾病发展趋势的监测，以观察各种因素对口腔疾病流行的影响。掌握“口腔流行病学概述及研究方法”知识点。